《中国居民膳食指南（2016）》一般人群膳食指南的适用人群是
A. 2岁以上健康人群
B. 6岁以上健康人群
C. 14岁以上健康人群
D. 18岁以上健康人群
E. 所有人群

正确答案：A。2岁以上健康人群

解析：本题考查《中国居民膳食指南（2016）》一般人群膳食指南的适用人群。《中国居民膳食指南（2016）》一般人群膳食指南的适用人群是2岁以上健康人群（A对BCDE错）。